肝性脑病病人血中支链氨基酸浓度降低的机制是
A. 支链氨基酸合成蛋白质
B. 支链氨基酸经肠道排出
C. 支链氨基酸经肾脏排出
D. 肌肉等组织摄取分解利用支链氨基酸增多
E. 支链氨基酸进入中枢神经

正确答案：D。肌肉等组织摄取分解利用支链氨基酸增多

解析：支链氨基酸主要在骨骼肌中进行代谢，胰岛素可促进肌肉组织摄取和利用支链氨基酸。肝功能严重障碍，胰岛素经肝细胞灭活清除不足，血中胰岛素水平增高，肌肉组织摄取和利用支链氨基酸增强（D对），血中支链氨基酸含量减少。